T细胞的生物学功能不包括
A. 产生细胞因子
B. 直接杀伤靶细胞
C. 参与对病毒的免疫应答
D. 诱导抗体的类别转换
E. 介导ADCC效应

正确答案：E。介导ADCC效应

解析：T细胞是淋巴细胞的主要组分，它具有多种生物学功能，如直接杀伤靶细胞（B对），辅助或抑制B细胞产生抗体，诱导抗体的类别转化（D对），促进有丝分裂原的应答反应以及产生细胞因子（A对）。CTL（细胞毒性T淋巴细胞）细胞可高效、特异的杀伤病毒感染的靶细胞（C对），而不损害正常细胞。ADCC（抗体依赖的细胞介导的细胞毒性作用）指表达IgG Fc受体的NK细胞、巨噬细胞和中性粒细胞等，通过与已结合在病毒感染细胞和肿瘤细胞等靶细胞表面的IgG抗体的Fc段结合，而杀伤这些靶细胞的作用，与B细胞有关（E错，为本题正确答案）。